使用化痰药治疗癫痫惊厥者，最常配伍的是
A. 清热、消食药
B. 平肝息风、安神药
C. 安神、理气药
D. 安神、泻下药
E. 补虚、消食药

正确答案：B。平肝息风、安神药

解析：癫痫是由于不同原因所致的脏腑失调，痰浊阻滞，气机逆乱，风阳内动所致，故用化痰药配平肝息风药，癫痫恢复期的治疗以健脾化痰，补益肝肾，养心安神为主，故可化痰药配安神药。惊厥与肝的关系十分密切，是由于外感或内伤引起的气机逆乱，升降失常，阴阳之气不相顺接所致，故常用化痰药配伍平肝息风药，故（B对）。